局部振动病的典型表现为
A. 发作性手指变白
B. 感应迟钝
C. 血管痉挛和变形
D. 肌无力、肌萎缩
E. 听力下降

正确答案：A。发作性手指变白

解析：本题考查局部振动病的典型表现。手臂振动病的典型表现是振动性白指（A对BCDE错），又称职业性雷诺现象，是诊断本病的重要依据。手臂振动病早期表现多为手部症状和类神经症。 其中以手麻、手痛、手胀、手僵等较为普遍。类神经症常表现为头痛、头昏、失眠、乏力、记忆力减退等，也可出现自主神经功能紊乱表现。